椎内静脉丛位于
A. 硬膜下隙
B. 椎体前
C. 椎体旁
D. 蛛网膜下隙
E. 硬膜外隙

正确答案：E。硬膜外隙

解析：硬脊膜与椎管内面的骨膜之间的间隙称硬膜外隙（P222）椎内静脉丛位于椎骨骨膜和硬脊膜之间（E对ABCD错），收集椎骨、脊膜和脊髓的静脉血。硬膜下隙（A错）位于硬脊膜与脊髓蛛网膜之间。（P394）脊髓蛛网膜与软脊膜之间有较宽阔的间隙称蛛网膜下隙(D错），两层膜之间有许多结缔组织小梁相连，间隙内充满脑脊液。